基本情绪是指
A. 快乐
B. 悲哀
C. 恐惧
D. 愤怒
E. 以上说法均正确

正确答案：E。以上说法均正确

解析：人们根据情绪与需要的关系，把快乐、悲哀、愤怒、恐惧作为基本情绪。掌握“情绪过程”知识点。